艾滋病的致病微生物是
A. 人类乳头瘤病毒
B. 人类免疫缺陷病毒
C. 口腔白色念珠菌感染
D. 唇疱疹
E. 口腔毛状白斑

正确答案：B。人类免疫缺陷病毒

解析：本题考查艾滋病的致病微生物。艾滋病的致病微生物是人类免疫缺陷病毒（B对）。艾滋病是获得性免疫缺陷综合征（AIDS）的简称，是由人类免疫缺陷病毒（HIV）感染引起的以CD4T淋巴细胞减少为特征的进行性免疫功能缺陷并继发各种机会性感染、恶性肿瘤和中枢神经系统病变。AIDS具有传播速度快、波及范围广及死亡率高等特点。人类乳头瘤病毒（A错）可导致各种疣和肿瘤。口腔白色念珠菌感染（C错）会导致口腔念珠菌病。唇疱疹（D错）和口腔毛状白斑（E错）不属于致病微生物。